第Ⅱ相生物结合代谢中发生的反应是
A. 氧化反应
B. 重排反应
C. 卤代反应
D. 甲基化反应
E. 乙基化反应

正确答案：D。甲基化反应

解析：本题考查药物化学结构与第Ⅱ相生物转化的规律。甲基化反应（D对）属于第Ⅱ相生物结合代谢中发生的反应。第Ⅱ相生物转化包括：1.与葡萄糖醛酸的结合反应、2.与硫酸的结合反应、3.与氨基酸的结合反应、4.与谷胱甘肽的结合反应、5.乙酰化结合反应、6.甲基化结合反应。而氧化反应（A错）属于第Ⅰ相生物转化。重排（B错）反应、卤代反应（C错）和乙基化反应（E错）为干扰项，不属于第二相生物转化反应。